月经周期基本正常，行经时间超过7天以上，甚至淋漓半月方净者称为
A. 经事延长
B. 经期延长
C. 月水不觉
D. 月水不觉
E. 以上都是

正确答案：E。以上都是

解析：月经周期基本正常，经期超过7天以上，甚或淋沥半月方净者，称为"经期延长"，亦称“月水不断”“经事延长”“月水不绝”等（E对）。